《中华人民共和国刑法》规定，生产、销售劣药，对人体健康造成严重危害的应
A. 给予警告
B. 判刑并处罚金
C. 处以罚款
D. 给予行政处分
E. 承担民事责任

正确答案：B。判刑并处罚金

解析：本题考查生产、销售、使用劣药的刑事责任。《中华人民共和国刑法》规定，生产、销售劣药，对人体健康造成严重危害的应判刑并处罚金（B对）。根据《刑法》第一百四十二条规定，生产、销售劣药，对人体健康造成严重危害的，处三年以上十年以下有期徒刑，并处罚金；后果特别严重的，处十年以上有期徒刑或者无期徒刑，并处罚金或者没收财产。